急性心肌梗死，肺部有湿啰音，但啰音范围小于1/2肺野，判断为
A. KillipⅠ级
B. KillipⅡ级
C. KillipⅢ级
D. NYHAⅡ级
E. NYHAⅣ级

正确答案：B。KillipⅡ级

解析：急性心肌梗死引起的心力衰竭按Killip分级法可分为四级，其中KillipⅡ级（B对）指肺部有湿啰音，但啰音范围小于1/2肺野；KillipI级（A错）指尚无明显心力衰竭；KillipⅢ级（C错）指有急性肺水肿，全肺大、小、干、湿啰音。而NYHA分级（P168）是没有急性心肌梗死但患有心力衰竭的患者的心功能分级标准，共分为四级，其中NYHA分级Ⅱ级（D错）指心脏病患者体力活动轻度受限，休息时无自觉症状，一般活动下可出现心衰症状。NYHA分级Ⅳ级（E错）指心脏病患者不能从事任何体力活动，休息状态下也存在心衰症状，活动后加重。